1945年，有一项研究调查了某手表厂表盘车间涂夜光的女工1000名和女话务员1000名，然后追踪观察并比较了她们从1945~1975年骨瘤发生率。结果30年间表盘车间女工发生了20例骨瘤，话务员中发生了4例骨瘤。表盘车间女工发生骨瘤的AR％约为
A. 0.8
B. 5
C. 2
D. 4
E. 无法计算

正确答案：A。0.8

解析：本题考查归因危险度百分比的计算。归因危险度百分比是指暴露人群中的发病或死亡归因于暴露的部分占全部发病或死亡的百分比。计算为＝（RR－1）/RR＝（5－1）/5×100%＝80%（A对BCDE错）。